按《中国药典》规定应进行黄曲霉毒素检査的药材有
A. 大枣
B. 肉豆寇
C. 全蝎
D. 柏子仁
E. 水蛭

正确答案：A、B、C、D、E。大枣；肉豆寇；全蝎；柏子仁；水蛭

解析：本题考查的是外源性有害物质及检测。按《中国药典》规定应进行黄曲霉毒素检査的药材有大枣（A对）、肉豆蔻（B对）、全蝎（C对）、柏子仁（D对）与水蛭（E对）。黄曲霉毒素：黄曲霉毒素为黄曲霉等的代谢产物，是强烈的致癌物质。各国对食品和药品中黄曲霉毒素的限量都做了严格的规定，但目前还没有公认的植物药中黄曲霉毒素的限量标准。《中国药典》规定用高效液相色谱法测定药材、饮片及制剂中的黄曲霉毒素（以黄曲霉毒素B₁、黄曲霉毒素B₂、黄曲霉毒素G₁和黄曲霉毒素G₂总量计）的限量，第一法为高效液相色谱-柱后衍生化法，第二法为高效液相色谱-串联质谱法，并规定当测定结果超出限度时，采用第二法进行确认。需进行黄曲霉毒素限量检查的药材和饮片有九香虫、土鳖虫、大枣、马钱子、地龙、肉豆蔻、延胡索、全蝎、决明子、麦芽、远志、陈皮、使君子、柏子仁、胖大海、莲子、桃仁、蜈蚣、蜂房、槟榔、酸枣仁、僵蚕、薏苡仁、水蛭。并规定每1000g样品中含黄曲霉素B₁不得过5μg，含黄曲霉毒素B₁、黄曲霉毒素B₂、黄曲霉毒素G₁和黄曲霉毒素G₂的总量不得过10μg。